当两眼平视时，若右眼瞳孔转向下外方，可能是哪块眼肌收缩所致
A. 内直肌
B. 上直肌
C. 上斜肌
D. 下斜肌
E. 以上都是

正确答案：C。上斜肌

解析：上斜肌（C对）使瞳孔转向下外方；内直肌（A错）使瞳孔转向内方；上直肌（B错）使瞳孔转向上内方；下斜肌（D错）使瞳孔转向上外方。